国外有关药物警戒信息中提示卡马西平可致
A. 成年后易发阴道癌
B. 心脏毒性
C. 皮肤反应
D. 心血管反应
E. 周围神经炎

正确答案：C。皮肤反应

解析：本题考查药物不良反应。国外有关药物警戒信息中提示卡马西平有导致严重皮肤反应（C对）的风险。